奇经八脉中与任脉在咽喉部相会的是
A. 冲脉
B. 督脉
C. 阴跷脉
D. 阳维脉
E. 阴维脉

正确答案：E。阴维脉

解析：阴维脉起于小腿内侧足三阴经交会之处，沿下肢内侧上行，至腹部与足太阴脾经同行，到胁部与足厥阴肝经相合，然后上行至咽喉，与任脉相会（E对）。冲脉（A错）起于胞中，下出会阴，从气街部起与足少阴经相并，挟脐上行，经喉，环绕口唇，到目眶下。督脉（B错）起于胞中，下出会阴，沿脊柱里面上行，至项后风府穴进入颅内，络脑，并由项沿头部正中线，经头顶、额部、鼻部、上唇，到上唇系带处。阴跷脉（C错）起于内踝下足少阴肾经的照海穴，沿内踝后直上小腿、大腿内侧，经前阴，沿腹、胸进入缺盆，出行于人迎之前，经鼻旁，到目内眦，与手足太阳经、阳跷脉会合。阳维脉（D错）起于外踝下，与足少阳胆经并行，沿下肢外侧向上，经躯干部后外侧，从腋后上肩，经颈部、耳后，前行到额部，分布于头侧及项后，与督脉会合。